患者，女，18岁，未婚。月经尚未初潮，体质虚弱，腰酸腿软，头晕目眩，舌红少苔，脉沉细尺弱。其治法是
A. 补气养血调经
B. 滋阴益气调经
C. 补肾养肝调经
D. 健脾生血调经
E. 补中益气调经

正确答案：C。补肾养肝调经

解析：患者18岁月经尚未初潮，体质虚弱，腰酸腿软，头晕目眩是先天禀赋不足，肾气未盛，精气未充，天癸匮乏所引起，是肾气亏虚之征，治疗采用补肾养肝调经（C对）。补气养血调经多用于闭经气血虚弱证（A错）。滋阴益气证多用于阴虚证（B错）。健脾生血调经多用于脾虚血虚证（D错）。补中益气调经多用于月经先期的脾气虚证（E错）。